一组观察值如果每个值都同时增加或减少一个不为0的常数，则
A. 均数改变，几何均数不变
B. 均数改变，中位数不变
C. 均数，几何均数和中位数都改变
D. 均数不变，几何均数和中位数改变
E. 均数，几何均数和中位数都不变

正确答案：C。均数，几何均数和中位数都改变

解析：本题考查描述集中位置常用指标的相关内容。算术均数M=（X1+X2+...+Xn）/n；中位数n为奇数时，是位于正中间的那个观测值，即第（n+1）/2个观测值，中位数M=X（n+1）/2。n为偶数时，是位于中间的两个观测值，即第n/2和第n/2+1个观测值的均数，即M=½（xn/2+xn/2+1）；几何均数G=n√X1·X2·...·Xn；因此，算术均数、中位数、几何均数都会改变（C对ABDE错）。